补骨脂具有的功效是
A. 祛寒除湿
B. 祛风止痒
C. 益肝明目
D. 活血止痛
E. 温脾止泻

正确答案：E。温脾止泻

解析：该题考查补骨脂的功效。补骨脂味苦、辛，性温，归肾、脾经，其功效为补肾壮阳，固精缩尿，温脾止泻，纳气平喘（E对）。